治疗支原体肺炎首选的抗生素是
A. 青霉素
B. 妥布霉素
C. 氨苄青霉素
D. 红霉素
E. 链霉素

正确答案：D。红霉素

解析：治疗支原体肺炎首选的抗生素是红霉素（D对），支原体肺炎的治疗应首选大环内酯类抗生素，包括红霉素、罗红霉素和阿奇霉素。